甘油在药剂中可用作
A. 助悬剂
B. 增塑剂
C. 保湿剂
D. 溶剂
E. 促透剂

正确答案：A、B、C、D。助悬剂；增塑剂；保湿剂；溶剂

解析：本题考查片剂的包衣。甘油在药剂中可用作助悬剂（A对）、增塑剂（B对）、保湿剂（C对）、溶剂（D对）。甘油又称丙三醇，是具有一定黏稠性的液体，能增加混悬剂中分散介质的黏度作助悬剂；甘油带有羟基，可作某些纤维素衣材的增塑剂；甘油能够吸水保水，可作保湿剂；甘油为极性溶剂，是一种优良溶剂；甘油无促透作用，不可用作促透剂（E错）。